一65岁女性患者，3年前因牙周病拔除后行全口义齿修复，效果理想。近日出现咬合疼痛。疼痛的可能原因是
A. 牙槽嵴有骨尖
B. 咬合力过大
C. 牙槽嵴吸收后基托边缘过长
D. 黏膜有炎症
E. 咬合不平衡

正确答案：C。牙槽嵴吸收后基托边缘过长

解析：本题考查全口义齿的调改。患者义齿戴用3年以上，出现疼痛，多由于牙槽嵴吸收后，义齿基托边缘过长所致（C对）。牙槽嵴有骨尖（A错）、咬合不平衡（B错）、咬合力过大（E错）、黏膜有炎症（D错）所引起的疼痛为义齿戴用初期产生疼痛的原因。